中缝软骨有两块，出现在Meckel软骨两端之间的结缔组织中，消失的时间是
A. 出生前1年
B. 出生后1年
C. 胚胎第12周
D. 胚胎第8周
E. 胚胎第10周

正确答案：B。出生后1年

解析：中缝软骨有两块，出现在Meckel软骨两端之间的结缔组织中，在生后1年消失。掌握“唾液腺与颌骨的发育”知识点。